女，18岁。2个月内4次出现进食时口腔疼痛。检查发现唇、颊、舌黏膜有多个直径小于5mm的溃疡，呈圆形或圆形，散在分布。最可能的诊断是
A. 口腔癌
B. 慢性口炎
C. 复发性口疮
D. 口腔黏膜白斑
E. 念珠菌性口炎

正确答案：C。复发性口疮

解析：本题考查复发性口疮的临床表现。女，18岁。2个月内4次出现进食时口腔疼痛。检查发现唇、颊、舌黏膜有多个直径小于5mm的溃疡，呈圆形或圆形，散在分布。最可能的诊断是复发性口疮（C对）。复发性口疮即复发性阿佛他溃疡，由题干“患者2个月内4次出现进食时口腔疼痛。检查发现唇、颊、舌黏膜有多个直径小于5mm的溃疡，呈圆形或圆形，散在分布”可知，该患者符合轻型复发性阿弗他溃疡的临床表现。口腔癌（A错）：多见于老年患者；病变好发于舌腹舌缘、口底、软腭复合体；溃疡深浅不一，边缘不齐，周围有浸润，质硬，底部菜花状；全身情况弱或恶病质。慢性口炎（B错）：主要分为三大类：①疱疹性口炎，主要症状为口内出现很多密集成片的小水疱，小水疱的水疱壁非常薄，在起水泡之后不久就会出现水疱的破溃，留下红肿出血的溃烂面。②细菌性口炎，主要症状为口腔黏膜出现红肿、溃烂，在溃烂的表面会出现黄白色的假膜，甚至口腔内会多发很多溃疡，伴发剧烈的疼痛。③白色念珠菌感染造成的真菌性口炎（E错），主要症状是口内出现白色的斑块，或者是白色的假膜，白色的斑块和假膜很难擦拭干净，并且口腔黏膜会有红肿和刺痛的现象。口腔黏膜白斑（D错）：好发于40岁以上的中老年男性，但近年来女性患者有增多的趋势。口腔白斑病可发生在口腔的任何部位。好发部位包括牙龈、颊黏膜咬合线区域和舌部，唇、前庭沟、腭、口底也有发生。患者可无症状或自觉局部粗糙、木涩,较周围黏膜硬。伴有溃疡或癌变时可出现刺激痛或自发痛。